伴有焦虑症的抑郁症患者宜选用
A. 帕罗西汀
B. 阿米替林
C. 度洛西汀
D. 文拉法辛
E. 吗氯贝胺

正确答案：A。帕罗西汀

解析：本题考查抑郁症的药物治疗。帕罗西汀（A对）适合治疗伴有焦虑症的抑郁者，作用快于三环类抗抑郁药。